心尖搏动点向左下移位常见于
A. 右心房增大
B. 心包积液
C. 右心室增大
D. 左心室增大
E. 左心房增大

正确答案：D。左心室增大

解析：左心室增大（D对）时，心尖搏动向左下移位；右心室增大（C错）时，心尖搏动向左侧移位；心房增大（AE错）时，心尖搏动移位不明显。心包积液（B错）时，心尖搏动减弱，并不发生移位。